巨大脾脏是下列哪种疾病的主要体征
A. 肝硬化脾功能亢进
B. 急性粒细胞白血病
C. 急性淋巴细胞白血病
D. 慢性粒细胞性白血病
E. 慢性淋巴细胞白血病

正确答案：D。慢性粒细胞性白血病

解析：慢性粒细胞白血病（D对）是一种影响血液及骨髓的恶性肿瘤，它的特点是产生大量不成熟的白细胞，这些白细胞在骨髓内聚集，抑制骨髓的正常造血；并且能够通过血液在全身扩散，导致病人出现贫血、容易出血、感染及器官浸润等，出现巨脾等体征。肝硬化脾功能亢进（A错）或慢性淋巴细胞白血病（E错）时，脾大但是还达不到巨脾（脾大超过肋下10cm者，称之为巨脾症）的程度。急性粒细胞白血病（B错）、急性淋巴细胞白血病（C错）和）都不会出现脾大的体征。